男，60岁。面色逐渐苍白，乏力伴牙龈出血半年。检查Hb60g/L，WBC3.3×10⁹/L，Plt35×10⁹/L。经骨穿细胞学检查诊断为骨髓增生异常综合症。为进行FAB分型，最重要的检查是
A. 网织红细胞
B. 骨髓铁染色
C. 染色体检查
D. 骨髓活检
E. 血清铁检查

正确答案：B。骨髓铁染色

解析：患者已诊断为骨髓异常增生综合征，现须进行FAB分型。骨髓异常增生综合征（MDS）的FAB分型主要根据患者外周血原始细胞比例、单核细胞计数（外周血涂片可获得）；骨髓中原始细胞的比例、Auer小体（由骨髓涂片获得）、环形铁粒幼细胞比例（由骨髓铁染色获得）等进行。患者已做外周血涂片，骨髓涂片细胞学检查，还需要骨髓铁染色检查环形铁粒幼细胞的比例，故为进行FAB分型，此患者最重要的检查是骨髓铁染色（B对）。骨髓活检（D错）主要用于科研，临床上少用；网织红细胞检查（A错）主要反映骨髓红系造血功能，对贫血的分类具有重要意义；染色体检查（P565）（C错）有助于MDS诊断，可发现MDS细胞遗传学改变，但对FAB分型无价值；血清铁检查（P542）（E错）主要用于缺铁性贫血的诊断。